原癌基因扩增
A. 出现新的原癌基因产物
B. 病毒基因组LTR插入细胞原癌基因
C. 原癌基因内单个碱基的替换
D. 原癌基因拷贝数增加
E. 原癌基因移至强启动子附近

正确答案：D。原癌基因拷贝数增加